β受体阻滞药对心脏的影响是
A. 降低心肌收缩力
B. 加快心率
C. 增加心输出量
D. 增加心肌耗氧量
E. 加快心房传导

正确答案：A。降低心肌收缩力

解析：β受体阻滞药阻断心脏β₁受体，使心率减慢（B错）、心肌收缩力减弱（A对）、心输出量减少（C错）、心肌耗氧量下降（D错）、血压稍降低，还能减慢心房和房室结的传导（E错）。